脑脊液的描述中，错误的是
A. 脑室脉络丛产生
B. 充满脑室
C. 存在于蛛网膜下隙与中央管
D. 经硬脑膜与蛛网膜之间回流
E. 经蛛网膜粒回流入上矢状窦

正确答案：D。经硬脑膜与蛛网膜之间回流

解析：脑脊液充满脑室（B对）系统，由脑室脉络丛产生（A对），经第四脑室正中孔和两个外侧孔流入脑和脊髓周围的蛛网膜下隙，存在于蛛网膜下隙与中央管（C对），然后脑脊液再沿此隙流向大脑背面的蛛网膜下隙经蛛网膜粒渗透到硬脑膜窦内（主要是上矢状窦）（E对D错，为本题正确答案），回流入血液中。